下列预防措施中哪项不是第一级预防
A. 合理营养
B. 保护环境
C. 预防接种
D. 定期复查
E. 健康教育

正确答案：D。定期复查